紫癜腹纹可见于
A. 经产妇
B. 曾经肥胖者
C. 腹水
D. 肾上腺皮质功能亢进
E. 小儿

正确答案：D。肾上腺皮质功能亢进

解析：紫癜腹纹是皮质醇增多症的常见征象即是皮质醇增多症的常见征象（D对）。经产妇，妇女妊娠时，在脐与耻骨之间的中线上有褐色素沉着，常持续至分娩后才逐渐消退（A错）。腹部膨降使腹壁真皮层的结缔组织因张力增高而萎缩或断裂，可产生银白色腹纹，常见于过度肥胖或曾患腹水者（BC错）。肥胖者或小儿（尤其餐后）腹部外形较饱满（E错）。